关于维生素D缺乏的临床表现及治疗，下列说法错误的是
A. 孕妇维生素D缺乏容易出现胎儿骨及免疫功能发育障碍
B. 婴幼儿维生素D缺乏容易出现“枕秃”
C. 小儿维生素D缺乏容易出现鸡胸、漏斗胸、“O”形或“X”形腿
D. 建议6个月以上婴幼儿适当增加户外活动，多晒太阳
E. 维生素D缺乏者在补充维生素D的同时，无需额外补充钙剂

正确答案：E。维生素D缺乏者在补充维生素D的同时，无需额外补充钙剂

解析：本题考查维生素D缺乏的临床表现及治疗。维生素D缺乏者在补充维生素D的同时要注意补钙（E错，为本题正确答案）。维生素D不足可导致继发性甲状旁腺功能亢进，增加骨吸收，从而引起或加重骨质疏松症。同时补充钙剂和维生素D可降低骨质疏松性骨折风险。孕妇维生素D缺乏易致先兆流产，胎儿脑、骨及免疫功能发育障碍（A对）。神经精神症状见于佝偻病活动初期和激期，小儿可有易激惹、烦躁、睡眠不安、夜惊、夜哭、多汗等，出现“枕秃”（B对）。重症患者常伴有贫血。建议6个月以上婴幼儿适当增加户外活动，多晒太阳（D对）。光照可以使皮肤维生素D合成增加，促进骨钙沉积。